男，58岁。高血压3年。使用ACEI药物降压效果不佳，为了更好控制血压，应该加用的药物为
A. 硝苯地平
B. 普萘洛尔
C. 氯苯那敏
D. 甘露醇
E. 呋塞米

正确答案：A。硝苯地平

解析：2级高血压病人在开始时就可以采用两种降压药物联合治疗，联合治疗有利于血压较快达到目标值，也利于减少不良反应。我国临床主要推荐应用优化联合治疗方案是：ACEI/ARB+二氢吡啶类CCB;ARB/ACEI+噻嗪类利尿剂；二氢吡啶类CCB+噻嗪类利尿剂；二氢吡啶类CCB+β受体拮抗剂。而呋塞米为袢利尿剂（E错）。故选二氢吡啶类药物硝苯地平（A对）。